完全代偿性酸或碱中毒时，血浆中HCO₃⁻/H₂CO₃的比值应为
A. 10：1
B. 15：1
C. 20：1
D. 30：1
E. 40：1

正确答案：C。20：1

解析：完全代偿性酸或碱中毒时，PH值在正常范围内，根据Henderson-Hasselbalch方程式可得血浆中HCO₃⁻/H₂CO₃的比值应为20/1。